人正常生活的最基本的心理条件是
A. 人际和谐
B. 情绪稳定
C. 人格完整
D. 智力正常
E. 适应环境

正确答案：D。智力正常

解析：人正常生活的最基本的心理条件是智力正常。只有智力正常，人们才能适应自然环境和社会环境（D对）。